下列说法正确的是
A. 据报道“2000年某市肺癌患病率为30／10万，肺癌死亡率为32／10万”。这里同年肺癌死亡率高于其患病率显然不正确
B. 某工厂保健站在调查中发现946名工人中，患慢性病的274人，其中女性219人，占80％，男性55人，占20％，由此得出结论，女工易患慢性病
C. 率的标准化是为了消除内部构成的影响
D. 某病的构成比增大，该病的发病率亦增高
E. 计算麻疹疫苗接种后血清检查的阳转率，分母为麻疹易感儿数

正确答案：C。率的标准化是为了消除内部构成的影响